有关精索内动脉的描述，正确的是
A. 发自髂内动脉
B. 经腹股沟管腹环入股管
C. 主要供应睾丸
D. 在盆腔中构成精索的一部分
E. 行程与女性的卵巢动脉完全相同

正确答案：C。主要供应睾丸

解析：精索内动脉发自腹主动脉（A错）的前壁。穿经腹股沟管入阴囊（B错）。主要供应睾丸（C对）。